男，45岁，经理，送来急诊，自述半小时前突然感到气紧，胸闷，心悸，头晕，出汗，认为生命垂危，要求紧急处理。近一月来，这种情况发生过3次，每次持续约0.5～1小时，发病间隙期一切正常，发病与饮食无明显关系。最适宜的急诊处理是
A. 输入葡萄糖
B. 输入氧气
C. 暗示治疗
D. 抗癫痫药
E. 安定注射

正确答案：E。安定注射

解析：该病例患者突然感到气紧以及认为生命垂危（惊恐发作表现），发作时有胸闷、心悸、头晕，出汗（自主神经症状），近一月来，反复发作，持续时间0.5-1小时（一个月之内存在数次惊恐发作，发作时间一般数分钟至数十分钟），故诊断为惊恐发作，苯二氮䓬类药物（BZD）治疗惊恐发作起效快，故选用安定（地西泮）（苯二氮䓬类药物（BZD））为最适宜的处理措施（E对）。惊恐发作的治疗方法包括药物治疗和心理治疗，心理治疗临床上采用认知行为治疗而非暗示治疗，暗示治疗多用于分离（转换）障碍（C错）。